胶囊剂不检查的项目是
A. 装量差异
B. 崩解时限
C. 硬度
D. 水分
E. 外观

正确答案：C。硬度

解析：本题考查胶囊剂。硬度（C错，为本题正确答案）检查是片剂的质量检查项，胶囊剂不需要检查硬度。胶囊剂的质量检项目主要包括：（1）胶囊剂应外观整洁（E对），不得有黏结、变形、渗漏或囊壳破裂现象，并应无异臭；（2）中药硬胶囊应做水分检查（D对）；（3）胶囊剂需要进行装量差异的检查（A对）；（4）胶囊剂需要进行崩解时限的检查（B对），按照崩解时限检查法检查，均应符合规定。